使淡水中藻类生长的主要物质是
A. 大量含氮硫、氯的污水进入缓流水体
B. 大量含钾、钠、磷的污水进入缓流水体
C. 大量含氨磷、钠的污水进入缓流水体
D. 大量含氮、磷的污水进入缓流水体
E. 大量含硫、镁、磷的污水进入缓流水体

正确答案：D。大量含氮、磷的污水进入缓流水体

解析：本题考查使淡水中藻类生长的主要物质。当大量含氮、磷的污水进入缓流水体时（D对ABCE错），可使淡水中藻类迅速生长繁殖。